合理用药的经济原则内涵主要有
A. 不滥用药物
B. 有利于环保
C. 使用方法简单
D. 使用廉价质优的药物
E. 降低中药资源的消耗

正确答案：A、B、C、D、E。不滥用药物；有利于环保；使用方法简单；使用廉价质优的药物；降低中药资源的消耗

解析：本题考查的是合理用药的经济原则。合理用药的经济原则内涵主要有不滥用药物（A对）、有利于环保（B对）、使用方法简单（C对）、使用廉价质优的药物（D对）与降低中药资源的消耗（E对）。合理用药的经济原则：所谓经济，即倡导用药要经济实用。一名合格的执业药师在建议临床医师或指导患者使用中药或中成药时，必须在用药安全、有效的前提下，除力争做到所推选的药物用法简便外，还必须做到用药不滥、经济实用，并有利于环境保护。最大限度地减轻患者的经济负担、降低中药材等卫生资源的消耗。